胃大部切除术后早期并发症是
A. 吻合口溃疡
B. 胃排空延迟
C. 贫血
D. 碱性反流性胃炎
E. 残胃癌

正确答案：B。胃排空延迟

解析：胃大部切除术后的早期并发症有术后出血、胃排空延迟（即术后胃瘫、胃排空障碍）（B对）、吻合口破裂或漏、十二指肠残端破裂、术后肠梗阻等。倾倒综合征、溃疡复发（以吻合口溃疡（A错）多见）、营养性并发症（如体重减轻、贫血）（C错）、碱性反流性胃炎（D错）、残胃癌（E错）等均为远期并发症。